下列对质量调整生存年数说法正确的是
A. 用权重系数来调整健康寿命而得到的新指标
B. 用生命质量来调整生存年数而得到的新指标
C. 用生命质量来调整健康寿命而得到的新指标
D. 用权重系数来调整期望寿命而得到的新指标
E. 用权重系数来调整生存年数而得到的新指标

正确答案：B。用生命质量来调整生存年数而得到的新指标

解析：本题考查质量调整生存年数的相关内容。质量调整生存年数是用生命质量来调整生存年数而得到的新指标（B对ACDE错）。